描述地方病的流行特征时，最常用的疾病统计指标是
A. 续发率
B. 患病率
C. 治愈率
D. 生存率
E. 罹患率

正确答案：B。患病率

解析：本题考查最常用的描述地方病流行特征的统计指标。患病率也称患病率，是指某特定时间内总人口中某病新旧病例之和所占的比例。患病率（B对ACDE错）是描述地方病流行特征最常用的疾病统计指标。